滑车神经可使眼球转向
A. 外下方
B. 内下方
C. 内上方
D. 外上方
E. 上方

正确答案：A。外下方

解析：滑车神经支配的眼外肌是上斜肌，上斜肌运动可使眼球转向外下方（A对）。